眶底和鼻眶筛骨折的重要体征是
A. 骨折移位
B. 眼球内陷
C. 复视
D. 眶周淤血、肿胀
E. 眶下区麻木

正确答案：B。眼球内陷

解析：眼球内陷是眶底和鼻眶筛骨折的重要体征。掌握“颧骨及颧弓、眼眶骨折及骨折愈合过程”知识点。